下列不属于性传播疾病的是
A. 淋病
B. 尖锐湿疣
C. 梅毒
D. 软下疳
E. 乙肝

正确答案：E。乙肝

解析：性传播性疾病是指通过性接触而传播的一类疾病，包括淋病（A对）、尖锐湿疣（B对）、梅毒（C对）、软下疳（D对）、性病性淋巴肉芽肿和腹股沟淋巴肉芽肿。乙肝为消化道系统疾病，通过血液、血流污染的物品、密切接触传播，不属于性传播疾病（E错，为本题正确答案）。